根据《中华人民共和国药品管理法实施条例》的规定，申请进口的药品，未在生产国家或者地区获得上市许可的
A. 在限定条件下可以依法批准进口
B. 不允许进口
C. 经出口国或地区药品管理部门批准后可以进口
D. 只要有市场就可以进口
E. 可无条件进口

正确答案：A。在限定条件下可以依法批准进口

解析：本题考察药品进口管理。申请进口的药品，未在生产国家或者地区获得上市许可的，在限定条件下可以依法批准进口（A对）。